患儿，7岁。发热2天，左侧腮部肿胀、疼痛，边缘不清，触之痛甚，咀嚼不便，伴头痛，咽痛，纳少，舌红苔薄黄，脉浮数。其治疗首选
A. 清瘟败毒饮
B. 黄连解毒汤
C. 柴胡葛根汤
D. 普济消毒饮
E. 小柴胡汤

正确答案：C。柴胡葛根汤

解析：该题考查对小儿痄腮的辩证以及方药。痄腮是由腮腺炎时邪(腮腺炎病毒)引起的一种急性传染病，以发热、耳下腮部肿胀疼痛为主要特征。邪犯少阳以轻微发热、耳下腮部漫肿疼痛、咀嚼不便为特征，全身症状不重。患儿，7岁。发热2天，左侧腮部肿胀、疼痛，边缘不清，触之痛甚，咀嚼不便，伴头痛，咽痛，纳少，舌红苔薄黄，脉浮数。可判断为小儿痄腮之邪犯少阳证，治法疏风清热，散结消肿。方药柴胡葛根汤、银翘散（C对）。清瘟败毒饮治疗痄腮变证邪陷心肝（A错）。黄连解毒汤、小柴胡汤未用于治疗小儿痄腮（BE错）。普济消毒饮治疗痄腮之热毒壅盛（D错）。